静脉注射后能促使组织液水分移至毛细血管内的是
A. 1.5%的氯化钠溶液
B. 丙种球蛋白
C. 5%葡萄糖溶液
D. 20%葡萄糖溶液
E. 白蛋白

正确答案：E。白蛋白

解析：血浆渗透压包括晶体渗透压与胶体渗透压，晶体渗透压主要取决于氯化钠、葡萄糖等晶体物质，胶体渗透压主要取决于血浆蛋白（80%取决于白蛋白）。晶体物质可自由通过毛细血管壁，血浆与组织液中晶体物质浓度几乎相等，所形成的晶体渗透压也基本相等，故氯化钠溶液（A错）、葡萄糖溶液（CD错）均不能使组织液水分移至毛细血管内。需注意1.5%的氯化钠溶液、20%葡萄糖溶液均为高渗溶液，可使细胞内的水分转移至细胞外。血浆蛋白不易通过毛细血管壁，静脉注射白蛋白（E对）后毛细血管内张力增高，可使组织液水分移至毛细血管内。而丙种球蛋白（B错）为免疫蛋白，在维持渗透压方面发挥作用极小。